男，24岁，吸烟，近一年来右下肢行走后疼痛，休息后好转，出现间歇性跛行。近一月来，右脚趾变黑皱缩，失去知觉，此种病变是
A. 液化性坏死
B. 固缩坏死
C. 干性坏疽
D. 湿性坏疽
E. 干酪样坏死

正确答案：C。干性坏疽

解析：青年男性患者，既往有吸烟史，出现右下肢行走后疼痛，休息后好转，间歇性跛行症状，诊断考虑为血栓闭塞性脉管炎（八版外科学P503）。血管节段性闭塞可导致患者下肢末端缺血性坏死，随着坏死程度逐渐加重，水分散失较多，坏死区域将变黑皱缩，失去知觉，形成干性坏疽（C对）。液化性坏死（P20）（A错）是指因坏死组织中可凝固的蛋白质少，或坏死细胞自身及浸润的中性粒细胞等释放大量水解酶，或组织富含水分和磷脂，导致细胞组织坏死后易发生溶解液化。固缩坏死（B错）即凋亡（P22），是指活体内局部组织中单个细胞的程序性死亡，其特点是细胞固缩，质膜完整，有凋亡小体形成。湿性坏疽（P21）（D错）是坏疽的一种分类，多发生于与外界相通的内脏。干酪样坏死（P21）（E错）是指坏死灶中脂质含量较多时，坏死区呈黄色，状似干酪，是坏死更为彻底的凝固性坏死。